以下何器官的静脉血不是经肾静脉回流的
A. 右侧肾
B. 左侧睾丸
C. 左侧肾
D. 右肾上腺和右侧睾丸
E. 无

正确答案：D。右肾上腺和右侧睾丸

解析：右肾上腺静脉和右睾丸静脉（D错，为本题正确答案）均注入下腔静脉，而不是经肾静脉回流的。